女，48岁。接触性出血3个月。妇科检查：宫颈呈糜烂状，宫体大小正常，活动好，双侧附件区无异常。三合诊（-）。阴道镜下活检病理示鳞状细胞癌，间质浸润深度6mm。术后常规病理：各切缘阴性，中分化鳞癌，无淋巴结转移及脉管浸润，应给予
A. 随访观察
B. 放化疗
C. 放射治疗
D. 化学治疗
E. 物理治疗

正确答案：A。随访观察

解析：该患者中年女性，接触性出血3个月（宫颈癌常表现为接触性出血，即性生活或妇科检查后阴道流血），宫颈呈糜烂状，宫体大小正常，活动好，双侧附件区无异常，三合诊（﹣），阴道镜下活检病理示鳞状细胞癌，间质浸润深度6mm（ⅠB1期：临床癌灶局限于子宫颈，间质内浸润深度＞5mm，癌灶≤4cm。ⅠB2期癌灶＞4cm，患者宫颈呈糜烂状，应视为其≤4cm），诊断为子宫颈癌ⅠB1期。行广泛性子宫切除术及盆腔淋巴结切除术，术后常规病理：各切缘阴性，中分化鳞癌，无淋巴结转移及脉管浸润，应给予随访观察（A对），随访内容包括盆腔检查、阴道脱落细胞学检查、胸部X线摄片、血常规及子宫颈鳞状细胞癌抗原（SCCA）等。放射治疗（C错）适用于术后病理检查发现有高危因素的辅助治疗。化学治疗（BD错）主要用于晚期或复发转移患者和同期放化疗。物理治疗（P303）（E错）用于CINⅠ的治疗。